证候不包括
A. 四诊检查所得
B. 内外致病因素
C. 疾病的特征
D. 疾病的性质
E. 疾病的全过程

正确答案：E。疾病的全过程

解析：证是疾病过程中某一阶段或某一类型的病理概括，一般由一组相对固定的，有内在联系的，能揭示疾病某一阶段或某一类型病变本质的症状和体征构成。证是病机的外在反映，病机是证的内在本质，由于病机的内涵汇总包括了病变的部位，原因（B对），性质（D对）和邪正盛衰（C对）变化，故证能够揭示病变的机理和发展趋势。病变的部位，原因，性质和邪正盛衰变化都是依据四诊检查（A对）得到的表现判断出来的（E错，为本题正确答案）。